患者，男，64岁，身高174cm，体重92kg。既往有高血压、高脂血症及心肌梗死病史，今日因反复胸闷就诊，临床处方，阿司匹林肠溶片、辛伐他汀片、特拉唑嗪片、氨氯地平片、曲美他嗪片、单硝酸异山梨酯注射液进行治疗，该患者使用的药物中有协调降压作用的药物是
A. 特拉唑嗪片、氨氯地平片、阿司匹林肠溶片
B. 特拉唑嗪片、氨氯地平片、单硝酸异山梨酯注射液
C. 特拉唑嗪片、氨氯地平片、辛伐他汀片
D. 特拉唑嗪片、辛伐他汀片、阿司匹林肠溶片
E. 氨氯地平片、曲美他嗪片、单硝酸异山梨酯注射液

正确答案：B。特拉唑嗪片、氨氯地平片、单硝酸异山梨酯注射液

解析：本组题考查心血管疾病的合理用药。该患者使用的药物中有协调降压作用的药物是特拉唑嗪片、氨氯地平片、单硝酸异山梨酯注射液（B对）。处方药物中阿司匹林肠溶片为抑制血小板聚集药物，辛伐他汀片为他汀类调脂药；特拉唑嗉片为α受体阻断剂，氨氯地平片为钙通道阻断剂，曲美他嗪片抑制脂肪酸氧化，增加葡萄糖代谢，单硝酸异山梨酯注射液为硝酸酯类药物，上述药物中，具有扩张血管的药物包括特拉唑嗪、氨氯地平和单硝酸异山梨酯注射液，故上述三药合用，可协同降压。